手足少阳经交接的部位在
A. 目内眦
B. 目眶下
C. 拇指端
D. 目外眦
E. 鼻翼旁

正确答案：D。目外眦

解析：十二经脉循行交接规律是：相表里的阴经与阳经在手足末端交接；同名的阳经与阳经在头面部交接；相互衔接的阴经与阴经在胸中交接。手足少阳经交接的部位在目外眦（D对）；手足太阳经交接于目内眦（A错）；任脉到目眶下（B错）；手太阴肺经与手阳明经交接于拇指端（C错）；手足阳明经交接与鼻翼旁（E错）。